胃溃疡应做的检查是
A. 上消化道钡餐造影
B. 小肠导管造影
C. 钡剂灌肠
D. 腹部透视
E. 断层摄影

正确答案：A。上消化道钡餐造影

解析：胃溃疡应做的检查是上消化道钡餐造影，上消化道造影检查是消化道疾病常用的检查方法（A对）。小肠导管造影双对比造影对中、小病变的诊断是很有效的方法，特别是对小的凹陷性病变能发挥最大的诊断作用（B错）。钡剂灌肠使得直肠、全部结肠及盲肠显影，可以用于检查大肠各种占位性病变（大肠癌）等（C错）。腹部透视可用于观察金属避孕环、胎儿位置和形态及误咽不透X线异物外，最常用于观察某些急腹症、血尿或腹部肿块（D错）。断层摄影可以逐层显示平片显影不清的重叠结构（E错）。